国家对新药生产实行
A. 特殊管理制度
B. 中药品种保护制度
C. 分类管理制度
D. 批准文号管理制度
E. 药品保管制度

正确答案：D。批准文号管理制度

解析：本题考查批准文号管理制度。国家对新药生产实行批准文号管理制度（D对）。《中华人民共和国药品管理法》第三十一条规定，生产新药或者已有国家标准的药品的，须经国院药品监督管理部门批准，并发给药品批准文号。《药品管理法》第五十四条规定：国家对药品实行处方药与非处方药分类管理制度（C错）。《药品管理法》第六十一条规定：疫苗、血液制品、麻醉药品、精神药品、医疗用毒性药品、放射性药品、药品类易制毒化学品等国家实行特殊管理（A错）的药品不得在网络上销售。